出生队列是指
A. 将同一民族的人列为一队
B. 将同一年龄组的人列为一队
C. 将同一性别的人列为一队
D. 将同一职业的人列为一队
E. 将同一时期出生的人列为一队

正确答案：E。将同一时期出生的人列为一队